慢性牙髓炎的疼痛特点为，除外
A. 不明显的阵发性隐痛
B. 每日可出现定时的钝痛
C. 患牙有明显的咬合痛
D. 有长期的冷热刺激痛病史
E. 患者一般多能定位患牙

正确答案：C。患牙有明显的咬合痛

解析：慢性牙髓炎的病程较长，有较长期的遇冷、热刺激痛或嚼食物痛史；有时有轻微的隐痛或定时自发性钝痛，患牙常有轻度咬合痛，一般均能明确指出患牙。也可有剧烈自发痛病史食物嵌入洞内激发痛史，也可有从无明显自发痛症状者。掌握“可复性、急慢性牙髓炎”知识点。